由单纯厌氧菌引起的感染约为
A. 0.05
B. 0.15
C. 0.35
D. 0.6
E. 0.9

正确答案：C。0.35

解析：由单纯厌氧菌引起的感染约为35%。掌握“口腔颌面部感染概论”知识点。